氯喹
A. 可杀灭疟原虫红内期裂殖体
B. 抗疟作用起效慢，作用强，持续时间久
C. 对疟原虫的原发性红外期裂殖体有效
D. 对疟原虫的继发性红外期裂殖体有效
E. 可杀灭血中疟原虫配子体

正确答案：A。可杀灭疟原虫红内期裂殖体

解析：本题考查氯喹的药理作用。氯喹可杀灭疟原虫红内期裂殖体（A对）。氯喹对各种疟原虫的红细胞内期裂殖体均有较强的杀灭作用，能迅速有效地控制疟疾的临床发作。